抗心律失常药分类和相应药物，不正确的是
A. ⅠA类适度阻滞钠通道-奎尼丁
B. ⅠB类轻度阻滞钠通道-利多卡因
C. ⅠC类高度阻滞钠通道-苯妥英钠
D. Ⅲ类延长动作电位时程药-胺碘酮
E. Ⅳ类钙通道阻滞药-维拉帕米

正确答案：C。ⅠC类高度阻滞钠通道-苯妥英钠

解析：抗心律失常药的分类：①Ⅰ类 钠通道阻滞药：Ⅰa类：适度阻滞钠通道。代表药物有奎尼丁（A对）、普鲁卡因胺等。Ib类：轻度阻滞钠通道，轻度降低动作电位。代表药物有利多卡因（B对）、苯妥英钠等（C错，为本题正确答案）。Ⅰc类 重度阻滞钠通道。代表药物有普罗帕酮、氟卡尼等。②Ⅱ类 β肾上腺素受体阻断药。代表药物有普萘洛尔、美托洛尔等。③Ⅲ类 延长动作电位时程药。代表药物有胺碘酮（D对）、索他洛尔等。④Ⅳ类 钙通道阻滞药。代表药物有维拉帕米（E对）、地尔硫草等。